对于甘草，以下说法中错误的是
A. 与白芍同用能缓急止痛
B. 容易助湿壅气
C. 久服重用易引起浮肿
D. 可缓解甘遂的毒烈之性
E. 风寒犯肺及肺有郁热之咳喘都可选用

正确答案：D。可缓解甘遂的毒烈之性

解析：本题考查的是甘草的性能特点、配伍与注意事项。甘草甘遂，不能同用（D错，为本题正确答案）。甘草：【性能特点】本品甘补润缓，生平偏凉，炙平偏温，主入脾、肺经，兼入胃、心经。既益气补中，又缓急止痛、缓和药性，还祛痰止咳（E对）、解毒。蜜炙补气缓急力强；生用能泻火解毒。【配伍】甘草配白芍：甘草味甘，功能补气缓急；白芍酸收，功能养血柔肝。两药相合，缓急止痛力强，治脘腹或四肢拘急疼痛。【使用注意】本品味甘，易助湿壅气（B对），故湿盛中满者不宜服。反大戟、甘遂、芫花、海藻，均忌同用。大剂量服用甘草，易引起浮肿，故不宜大量久服（C对）。